两侧鼻前孔之间的隆嵴是
A. 鼻面沟
B. 唇面沟
C. 颏唇沟
D. 鼻唇沟
E. 鼻小柱

正确答案：E。鼻小柱

解析：鼻小柱为两侧鼻前孔之间的隆嵴。掌握“面部表面解剖”知识点。